患者，女，54岁，绝经1年，因严重潮热、盗汗、失眠，生活受到明显影响就诊。患者想改善上述症状，但不希望有月经。宜选用的治疗方案是
A. 雌、孕激素序贯治疗
B. 雌、孕激素连续联合治疗
C. 单纯雌激素治疗
D. 单纯孕激素治疗
E. 阴道局部用雌激素治疗

正确答案：B。雌、孕激素连续联合治疗

解析：本题考查绝经综合征。宜选用的治疗方案是雌、孕激素连续联合治疗（B对）。雌、孕激素连续联合治疗方案适用于有完整子宫、绝经后不希望有月经样出血的妇女。可采用每日雌激素（口服或经皮）加孕激素，连续给药；也可采用复方制剂如雌二醇-屈螺酮片，1片/天，连续给药。雌、孕激素序贯治疗（A错）方案：适用于有完整子宫、围绝经期或绝经后仍希望有月经样出血的妇女。单纯雌激素治疗（C错）方案适用于子宫已切除的妇女，通常连续应用。单纯孕激素周期治疗（D错）方案适用于绝经过渡期早期，调整卵巢功能衰退过程中出现的月经问题。阴道局部用雌激素治疗（E错）：可使用雌三醇乳膏、普罗雌烯阴道胶丸、结合雌激素软膏，1次/天，连续使用2周，症状缓解后改为2次/周。短期（3～6个月）局部应用雌激素阴道制剂无需加用孕激素，但缺乏超过1年使用的安全性数据，长期使用者应监测子宫内膜状况。